长期应用糖皮质激素可发生
A. 二重感染
B. 医源性皮质醇增多症
C. 撤药综合征
D. 骨质疏松
E. 肾病综合征

正确答案：B、C、D。医源性皮质醇增多症；撤药综合征；骨质疏松

解析：本题考查长期应用糖皮质激素的不良反应。长期应用糖皮质激素可发生医源性皮质醇增多症（B对）、撤药综合征（C对）、骨质疏松（D对）。长期大剂量应用引起的不良反应：1.医源性肾上腺皮质功能亢进症（库欣综合征）；2.诱发或加重感染；3.心血管系统并发症；4.消化系统并发症；5.肌肉萎缩、骨质疏松、伤口愈合迟缓等；6.糖尿病；7.其他。可导致白内障，儿童更易发生，停药后可能不会完全恢复，甚至继续加重，故长期应用时应定期进行裂隙灯检查。尚可导致糖皮质激素性青光眼。尚能诱发精神病或癫痫。停药反应：1.医源性肾上腺皮质功能不全；2.反跳现象（撤药综合征）。二重感染（A错）是指长期或大量应用广谱抗菌药物,人体内敏感菌被抑制,而未被抑制的细菌及真菌乘机大量繁殖,引起菌群失调而致继发感染。肾病综合征（E错）是糖皮质激素的适应证。